与雌激素配伍为避孕药的孕激素是
A. 黄体酮
B. 甲睾酮
C. 雌二醇
D. 苯丙酸诺龙
E. 醋酸甲地孕酮

正确答案：E。醋酸甲地孕酮

解析：本题考查醋酸甲地孕酮。与雌激素配伍为避孕药的孕激素是醋酸甲地孕酮（E对）。醋酸甲地孕酮可与雌激素配伍作为短效复方口服避孕片的孕激素成分。黄体酮（A错）为天然孕激素，用于习惯性流产、痛经、经血过多或血崩症、闭经等。甲睾酮（B错）用于雄激素缺乏的替代治疗。雌二醇（C错）为天然雌激素，用于卵巢功能不全或卵巢激素不足引起的各种症状。苯丙酸诺龙（D错）为蛋白同化激素，用于蛋白质缺乏症。